具有透皮吸收促进作用的物质包括
A. 二甲基亚砜
B. 微粉硅胶
C. 月桂氮䓬酮
D. 薄荷脑
E. 乳糖

正确答案：A、C、D。二甲基亚砜；月桂氮䓬酮；薄荷脑

解析：本题考查透皮吸收促进剂。常用的透皮吸收促进剂有乙醇、丙二醇、聚乙二醇、甘油、尿素及衍生物、二甲基亚砜（A对）、二甲基乙酰胺、二甲基甲酰胺、月桂氮䓬酮（C对）、油酸、挥发油（D对）、表面活性剂等。微粉硅胶（B错）常用作片剂的润滑剂。乳糖（E错）常用作片剂的填充剂。